女性，28岁，主诉：半年来全口牙龈逐渐肿大，刷牙出血。如诊断为妊娠期龈炎，临床检查最有可能的发现是
A. 牙龈色鲜红、肿大
B. 龈乳头出现溃疡
C. 牙龈疼痛、出血伴恶臭
D. 牙龈化脓、疼痛
E. 牙龈质地坚韧

正确答案：A。牙龈色鲜红、肿大

解析：妊娠期龈炎可发生于个别牙龈或全口的牙龈，以前牙区为重。龈缘和龈乳头呈鲜红或暗红色，松软而光亮，或呈现显著的炎性肿胀、肥大，有龈袋形成，轻触之即易出血，患者吮吸或进食时也易出血，此常为就诊时的主诉症状。一般无疼痛，严重时龈缘可有溃疡和假膜形成，此时可有轻度疼痛。掌握“妊娠期龈炎”知识点。